11岁小孩无诱因出现右关节肿胀疼痛不能动，主动被动运动均受限，浮髌试验阳性，关节腔内分层抽出浑浊液体送检培养，问大概率是什么细菌
A. 结核杆菌
B. 乙脑致病菌
C. 金黄色葡萄球菌
D. 大肠杆菌
E. 溶血杆菌

正确答案：C。金黄色葡萄球菌

解析：患者11岁小孩无诱因出现右关节肿胀疼痛不能动（化脓性关节炎的表现），主动被动运动均受限，浮髌试验阳性，关节腔内分层抽出浑浊液体送检培养（化脓性关节炎的辅助检查结果），结合患者的表现和辅助检查，诊断为化脓性关节炎，提示为金黄色葡萄球菌（C对DE错）。